主要由机械摩擦作用而造成的牙齿硬组织渐进丧失的疾病，称为
A. 龋病
B. 磨损
C. 酸蚀
D. 牙震荡
E. 牙隐裂

正确答案：B。磨损

解析：磨损指主要由机械摩擦作用而造成的牙齿硬组织渐进丧失的疾病。掌握“磨损”知识点。